关于药品进口管理的说法，正确的是
A. 经批准，医疗机构因临床急需进口的少量药品，应当在指定医疗机构内用于特定医疗目的
B. 进口药品的检验样品不易贮存的，应当至少保存至有效期届满
C. 从境外进入保税仓库、保税区、出口加工区的药品，按规定办理进口审批和口岸检验登记备案等手续
D. 中国食品药品检定研究院负责药品口岸检验机构的指定和审核工作

正确答案：A。经批准，医疗机构因临床急需进口的少量药品，应当在指定医疗机构内用于特定医疗目的

解析：本题考查的是临床急需少量药品批准进口要求。关于药品进口管理的说法，正确的是经批准，医疗机构因临床急需进口的少量药品，应当在指定医疗机构内用于特定医疗目的（A对）。临床急需少量药品批准进口要求：根据《药品管理法》的有关规定，医疗机构因临床急需进口少量药品的，经国家药品监督管理局或国务院授权的省级人民政府批准，可以进口。进口的药品应当在指定的医疗机构内用于特定医疗目的，不得擅自扩大使用单位或使用目的。进口药品的检验样品应当保存至有效期满。不易贮存的留样，可根据实际情况掌握保存时间（B错）。索赔或者退货检品的留样应当保存至该案完结时。超过保存期的留样，由口岸药品检验所予以处理并记录备案。从境外进入保税仓库、保税区、出口加工区的药品，免予办理进口备案和口岸检验等进口手续（C错），海关按有关规定实施监管；从保税仓库、出口监管仓库、保税区、出口加工区出库或出区进入国内的药品，按本办法有关规定办理进口备案和口岸检验等手续。经批准以加工贸易方式进口的原料药、中药材等，免予办理进口备案和口岸检验等进口手续，其原料药及制成品禁止转为内销。确因特殊情况无法出口的，移交地方药品监督管理部门按规定处理，海关予以核销。中国食品药品检定研究院负责进口药品口岸检验工作的指导和协调（D错）。口岸检验所需标准品、对照品由中国药品生物制品检定所负责审核、标定。